患者，男性，68岁，右下牙龈癌，拟行颌颈联合根治术+胸大肌、肋骨复合组织瓣修复术。该骨肌皮瓣血供来源于
A. 胸背动脉
B. 胸肩峰动脉
C. 颈横动脉
D. 肋间动脉
E. 胸廓内动脉

正确答案：B。胸肩峰动脉

解析：本题考查骨肌皮瓣的血供来源。该患者拟行胸大肌、肋骨复合组织瓣修复术，该骨肌皮瓣血供来源于胸肩峰动脉（B对）。肋骨胸大肌血供来源于胸肩峰动脉；肋骨背阔肌血供来源于胸背动脉（A错）；肩胛骨斜方肌血供来源于颈横动脉（C错）；肋骨肋间肌血供来源于肋间动脉（D错）。